初产妇，26岁。妊娠43周，临产后5小时。胎头高浮，胎心140次/min，宫口开大2cm。6小时后自然破膜，立即听胎心，减慢至80次/min。本例应首先考虑的是
A. 脐带脱垂
B. 胎盘功能不良
C. 宫体包裹胎体
D. 脐带缠绕胎儿颈部
E. 胎头受压，脑血流量一时性减少

正确答案：A。脐带脱垂